某患者，一上前牙牙冠大部缺损，作桩冠修复时，根管制备的长度应达到根长的
A. 1/5
B. 1/4
C. 2/5
D. 2/3
E. 4/5

正确答案：D。2/3

解析：本题考查桩核冠的设计要求。桩的长度应符合：根尖区须保留不少于4mm的根充物；保证桩的长度不短于临床牙冠高度；骨内桩长度大于骨内根长度的1/2。桩的长度应达到根长的2/3～3/4（D对）。若根管治疗长度过短如1/5（A错）、2/5（C错）、1/4（B错）则会导致桩的长度过短，桩冠固位力较小，导致冠折。若根管治疗的长度过长如根长的4/5（E错），根尖处牙体组织较少，而致根折。